青光眼病人的眼压约在22～42mmHg范围，非青光眼病人的眼压约在14～26mmHg范围内，根据这些资料，可以认为：采用两项筛检试验并联使用，可以使筛检试验的哪一特征增加：
A. 灵敏度增加
B. 特异度增加
C. 领先时间增加
D. 阳性预测值增加
E. 患病率增加

正确答案：A。灵敏度增加

解析：本题考查提高筛检收益的方法。并联试验也称平行试验，即全部筛检试验同时平行开展，任何一项筛检试验结果阳性就可判定为阳性。该方法的优点是可以弥补两种方法灵敏度都不足的问题，提高筛查整体的灵敏度。采用两项筛检试验并联使用，可以使筛检试验的灵敏度增加（A对BCDE错）。